颈丛
A. 由Cl~4后支构成
B. 位于胸锁乳突肌上部的浅面
C. 胸锁乳突肌后缘中点附近，是颈部皮肤浸润庥醉的阻滞点
D. 发出纯运动性的膈神经
E. 无

正确答案：C。胸锁乳突肌后缘中点附近，是颈部皮肤浸润庥醉的阻滞点

解析：颈丛由第1~4颈神经前支相互交织构成（A错），于胸锁乳突肌上部的深面（B错），中斜角肌和肩胛提肌起始端的前方。颈丛皮支由深面浅出的部位，是颈部浅层结构浸润麻醉的重要阻滞点（C对）。膈神经为混合性神经（D错）。